男，54岁。肛门胀痛6天。为持续性痛，逐渐加重，排便和行走时出现剧痛，有里急后重感和排便困难，伴发热，全身不适。查体：T39.6℃，肛门左侧红肿有明显压痛。肛诊：直肠左侧饱满，压痛（+），有波动感。实验室检查：WBC21×10⁹/L，N0.92。最可能的诊断是
A. 骨盆直肠间隙脓肿
B. 肛门周围皮下脓肿
C. 肛管括约肌间隙脓肿
D. 坐骨肛管间隙脓肿
E. 直肠壁内脓肿

正确答案：D。坐骨肛管间隙脓肿

解析：患者男，54岁，出现肛门胀痛，为持续性痛，逐渐加重，排便和行走时出现剧痛，有里急后重感和排便困难，伴发热，全身不适，查体可见肛门左侧红肿有明显压痛。肛诊：直肠左侧饱满，压痛（+），有波动感等，结合患者的表现和查体，符合坐骨肛管间隙脓肿（D对）。骨盆直肠间隙脓肿早期就有全身中毒症状，如发热、寒战、全身疲倦不适 局部表现为直肠坠胀感，便意不尽，排便时尤感不适，常伴排尿困难（A错）。肛门周围皮下脓肿（B错）没有直肠刺激征。肛管括约肌间隙脓肿（C错）和直肠壁内脓肿（E错）由于位置较深，局部症状大多不明显，主要表现为会阴、直肠部坠胀感，排便时疼痛加重。